治疗肺脾气虚型小儿遗尿的代表方剂是
A. 菟丝子散
B. 沙参麦冬汤
C. 参苓白术散
D. 交泰丸合导赤散
E. 补中益气汤合缩泉丸

正确答案：E。补中益气汤合缩泉丸

解析：该题考查小儿遗尿证型的方药。小儿遗尿肺脾气虚型 ，症状见睡中遗尿,但尿频而量少,兼面白神疲,四肢乏力,自汗易感,食欲不振,大便溏薄,舌淡,脉缓或弱,指纹色淡。治法为补肺益脾，固涩膀胱。方药为补中益气汤合缩泉丸加减（E对）。菟丝子散治疗肾气不足（A错）。沙参麦冬汤治疗麻疹阴津耗伤(恢复期)（B错）。参苓白术散治疗泄泻脾虚泻（C错）。交泰丸合导赤散治疗心肾失交（D错）。